不属于鳖甲性状特征的是
A. 呈椭圆形或卵圆形，背面隆起
B. 外表面黑褐色或墨绿色，密布网状细皱纹
C. 外表面两侧各有左右对称的横凹纹8条
D. 内表面类白色，中部有突起的脊椎骨
E. 内表面两侧肋骨不伸出背甲边缘

正确答案：E。内表面两侧肋骨不伸出背甲边缘

解析：本题考查的是鳖甲药材的性状鉴别。鳖甲药材两侧有对称的肋骨各8条，伸出边缘（E错，为本题正确答案）。鳖甲：【性状鉴别】药材呈椭圆形或卵圆形，背面隆起（A对）。外表面黑褐色或墨绿色，略有光泽，具细网状皱纹（B对）和灰黄色或灰白色斑点，中间有一条纵棱，两侧各有左右对称的横凹纹8条（C对），外皮脱落后，可见锯齿状嵌接缝。内表面类白色，中部有突起的脊椎骨（D对），颈骨向内卷曲，两侧有对称的肋骨各8条，伸出边缘。质坚硬。气微腥，味淡。